具有固精缩尿，温脾摄唾功效的药物是
A. 肉苁蓉
B. 沙苑子
C. 补骨脂
D. 山茱萸
E. 益智仁

正确答案：E。益智仁

解析：该题考查益智仁的功效，属记忆内容。益智仁味辛性温，归肾、脾经。其功效为暖肾固精缩尿，温脾开胃摄唾（E对）。